龈上洁治术通常将全口牙分为若干区段洁治，常见区段数为
A. 2
B. 4
C. 6
D. 8
E. 以上均可

正确答案：C。6

解析：本题考查龈上洁治术。龈上洁治术通常将全口牙分为若干区段洁治，常见区段数为6（C对）。在洁治过程中，常将患者的全口牙分为上颌、下颌的前牙及后牙左右侧6个区段，逐区进行洁治。